影响健康的个人因素不包括
A. 健康的婴幼儿发育状态
B. 个人的生活行为方式
C. 个人的能力和技能
D. 人类生物学特征和遗传因素
E. 个人的心理状态

正确答案：E。个人的心理状态

解析：影响健康的个人因素：包括健康的婴幼儿发育状态、个人的生活行为方式和习惯、个人的能力和技能，以及人类生物学特征和遗传因素。掌握“预防医学概论、健康及三级预防策略”知识点。